哪项不是病毒感染对宿主细胞的直接作用
A. 杀细胞感染
B. 细胞融合
C. 病毒与宿主细胞基因组整合
D. 形成包涵体
E. 产生超敏反应

正确答案：E。产生超敏反应